治疗原发性支气管肺癌阴虚毒热证，应首选
A. 沙参麦冬汤合五味消毒饮
B. 血府逐瘀汤
C. 导痰汤
D. 沙参麦冬汤
E. 十枣汤

正确答案：A。沙参麦冬汤合五味消毒饮

解析：原发性支气管肺癌阴虚毒热证，其机理为毒热滞肺日久，郁而化热，耗伤肺阴，故治法为养阴清热，解毒散结，应首选滋阴润肺的沙参麦冬汤合清热凉血解毒的五味消毒饮（A对）来滋阴解毒，前者主要清养肺胃，降逆下气，后者清热解毒，消散痈肿。血府逐瘀汤（B错）常用于治疗气滞血瘀证；导痰汤（C错）常用于治疗痰壅内结证；沙参麦冬汤（D错）常用于治疗气阴两虚证；十枣汤（E错）常用于治疗悬饮、实水证。